糖皮质激素可用于治疗
A. 各种休克
B. 严重精神病
C. 活动性消化性溃疡
D. 病毒感染
E. 严重高血压、糖尿病

正确答案：A。各种休克